《素问·生气通天论》“味过于甘”则
A. 筋脉沮弛，精神乃央
B. 脾气不满，胃气乃厚
C. 肝气以津，脾气乃绝
D. 大骨气劳，短肌，心气抑
E. 心气喘满，色黑，肾气不衡

正确答案：E。心气喘满，色黑，肾气不衡

解析：《素问·生气通天论》：“味过于酸，肝气以津，脾气乃绝（C错）；味过于咸，大骨气劳，短肌，心气抑（D错）；味过于甘，心气喘满，色黑，肾气不衡（E对）；味过于苦，脾气不濡，胃气乃厚（B错）；味过于辛，筋脉沮弛，精神乃殃（A错）。”味过于甘，会使心气喘满，颜面发黑，肾气失于平衡。